病人瞳孔向外斜视是损伤了
A. 眼神经
B. 展神经
C. 三叉神经
D. 视神经
E. 滑车神经

正确答案：E。滑车神经

解析：滑车神经（E对）支配上斜肌，上斜肌牵拉瞳孔转向下外方，滑车神经损伤后，上斜肌瘫痪，使向外斜视。